患儿口腔内有多个牙面龋坏的牙齿，为确保乳牙的正常宽度和高度多采用
A. 银汞合金充填
B. 可摘式保持器
C. 功能性活动保持器
D. 金属成品冠修复牙体
E. 固定式间隙保持器

正确答案：D。金属成品冠修复牙体

解析：本题考查金属预成冠修复。金属成品冠修复牙体易恢复牙冠的解剖外形和功能（D对）。银汞合金充填抗压强度好、耐磨性能强、性能稳定，但银汞合金颜色不适于前牙修复，因口内有多个牙面龋坏的牙齿，且充填不能确保乳牙的正常宽度和高度，不宜用银汞合金充填（A错）。可摘式保持器（B错）、功能性活动保持器（C错）、固定式间隙保持器（E错）属保持器范畴，不适用于龋病的治疗。